一患儿，腹部剧烈疼痛伴恶心呕吐，以急腹症入院，术中见肠套叠，肠管暗红，表面无光泽，该处可见纤维素样物附着，该肠管可能发生下列哪种病变
A. 静脉淤血
B. 动脉充血
C. 肠管梗死
D. 急性肠炎
E. 肠腔化脓

正确答案：C。肠管梗死

解析：—患儿，腹部剧烈疼痛伴恶心呕吐，以急腹症入院，术中见肠套叠，肠管暗红，表面无光泽，可见纤维素样物附着等符合肠管梗死（C对）的临床表现，该患儿是由于肠套叠引起的机械性肠管梗死，在术中要判断肠管的活力，以决定手术方式。而静脉淤血（A错）即静脉淤血是指局部组织或器官的毛细血管和小静脉内含血量增多，常见原因有静脉受压使管腔使管腔发生狭窄或闭塞（如肿瘤压迫局部静脉）、静脉腔阻塞（如静脉血栓形成阻塞静脉回流受阻）和心力衰竭（如二尖瓣狭窄时引起左心衰竭导致肺淤血）。动脉充血（B错）是指局部组织或器官动脉输入血量增多，以致动脉血管内含血量增多，常见原因有生理性充血（如进食后胃肠道黏膜充血）、炎症性充血（如组织胺等血管活性物质作用使细动脉扩张充血）和减压后充血（如绷带包扎的肢体在突然解除压力后受压组织内的细动脉发生反射性扩张）。急性肠炎（D错）多由细菌感染或饮食不当引起，在我国以夏、秋两季发病率最高，无性别差异，主要表现为恶心、呕吐、腹泻等，故该患儿不考虑此病。肠腔化脓（E错）多是由于感染化脓性细菌引起的，可有腹痛、恶心、呕吐、排便里急后重等表现。